患者见憎寒壮热，口苦而干，二便秘涩，头晕目赤，舌苔黄腻，脉数治宜选方
A. 银翘散
B. 麻杏甘石汤
C. 防风通圣散
D. 大柴胡汤
E. 桑菊饮

正确答案：C。防风通圣散

解析：“憎寒壮热”提示风热之邪在表，正邪相争；“头晕目赤”风热之邪上攻的表现；“口苦而干，二便秘涩”提示内有蕴热；“舌苔黄腻，脉数”有实热的表现，治当疏风解表，泻热通便，方选防风通圣散（C对）。方中防风、荆芥、薄荷、麻黄轻浮升散，解表散寒，使风热从汗出而散之于上；大黄、芒硝破结通幽，栀子、滑石降火利水，使风热从便出而泄之于下。风淫于内，肺胃受邪，桔梗、石膏清肺泻胃。风之为患，肝木受之，川芎、当归、芍药和血补肝。黄芩清中上之火，连翘散结血凝，甘草缓峻而和中，白术健脾而燥温。